慢性病患者下调生活期望，生命质量评价
A. 一定高于健康者
B. 可能比健康者更高
C. 一定低于健康者
D. 必然与健康者保持一致
E. 以上都不对

正确答案：B。可能比健康者更高